中药中有机化合物结构鉴定的常用方法有
A. 质谱
B. 紫外光谱
C. 红外光谱
D. 核磁共振谱
E. 高效液相色谱

正确答案：A、B、C、D。质谱；紫外光谱；红外光谱；核磁共振谱

解析：本题考查的是结构鉴定方法。中药中有机化合物结构鉴定的常用方法有质谱（A对）、紫外光谱（B对）、红外光谱（C对）与核磁共振谱（D对）。中药化合物结构研究中采用的主要方法：质谱（MS）、红外光谱（IR）、紫外-可见吸收光谱（UV）、核磁共振谱（NMR）。高效液相色谱法（HCLP）（E错）可用于中药化合物的成分测定。